男，21岁。近6个月来在家中闭门不出，认为有人在拿自己做试验，用射线照射自己，有人监控自己，使自己活不下去了，只有躲在家中才安全。既往体健，无精神病家族史。该患者的主要症状为
A. 关系妄想
B. 夸大妄想
C. 内心被揭露感
D. 疑病妄想
E. 被害妄想

正确答案：E。被害妄想

解析：该患者近6个月闭门不出，觉得有人用射线照射他，拿他做实验，有人监控自己（坚信自己被某些人迫害）为被害妄想的表现（E对）。关系妄想是指患者认为周围环境中所发生的与自己无关的事情均与自己有关（A错）。夸大妄想是患者认为自己拥有非凡的才能、智慧、财富、权利、地位等，如称自己是著名的科学家、发明家、大富翁等（B错）。内心被揭露感（思维被洞悉感）的患者感到内心所想的事情，虽然没有说出，也没有用文字书写出来，但被别人都知道了（C错）。疑病妄想的患者毫无根据地坚信自己患了某种严重的躯体疾病或不治之症，因而到处求医，各种详细的检查和反复的医学验证也不能纠正（D错）。